引起严重急性呼吸综合征（SARS）的病原体是
A. 肺炎衣原体
B. 军团菌
C. 肺炎支原体
D. 副黏病毒
E. 新型冠状病毒

正确答案：E。新型冠状病毒